女，29岁。焦虑不安，紧张，多食，体重减轻5月余。为明确诊断，需要检查的是
A. 血T₃、T₄、TSH
B. 血钾
C. 肝功能
D. 肾功能
E. 血糖

正确答案：A。血T₃、T₄、TSH

解析：患者青年女性（甲亢的好发人群），有焦虑不安，紧张，多食，体重减轻（甲亢的常见临床表现）等症状，最可能的诊断为甲状腺功能亢进，为明确诊断，需要检查的是血T₃、T₄、TSH（A对）。血清TSH（促甲状腺激素）浓度的变化是反映甲状腺功能最敏感的指标，目前sTSH（敏感TSH）成为筛查甲亢的第一线指标（P684）。血钾（B错）检查主要用于确诊患者是否存在血钾浓度的异常。肝功能（C错）、肾功能（D错）为临床常规检查，主要用于反映肝、肾功能基本状况。血糖（E错）检查主要用于糖尿病的确诊。